关于紫绀的描述何项是错误的
A. 缺氧不一定有紫绀
B. 毛细血管中还原红蛋白超过5g%便出现紫绀
C. 红细胞增多症患者也易出现紫绀
D. 严重贫血引起的缺氧，紫绀一般较明显
E. 紫绀是否明显，还和皮肤粘膜中的血量有关

正确答案：D。严重贫血引起的缺氧，紫绀一般较明显

解析：紫绀是指毛细血管中脱氧血红蛋白达到或超过5g/dl时（B对），皮肤和黏膜呈青紫色。在血红蛋白正常的人，紫绀与缺氧同时存在，但血红蛋白过多或多少时，紫绀与缺氧长不一致，缺氧不一定有紫绀（A对），紫绀不一定有缺氧，紫绀是否明显，还与皮肤粘膜中的血量有关（E对）。红细胞增多症患者易出现紫绀（C对），但严重贫血引起的缺氧时，紫绀不一定明显（D错，为本题正确答案）。